安鲁米特的抗癌作用机制
A. 影响蛋白质的合成和功能
B. 直接破坏DNA结构
C. 干扰核酸生物合成
D. 干扰生物碱合成
E. 影响体内激素平衡

正确答案：E。影响体内激素平衡

解析：本题考查安鲁米特的作用机制。安鲁米特是影响体内激素平衡的药物（E对），通过与雄激素竞争肿瘤部位的雄激素受体，抑制雄激素与靶器官的结合，从而治疗前列腺癌。影响蛋白质的合成和功能（A错）的药物有长春碱。直接破坏DNA结构（B错）的有烷化剂。干扰核酸生物合成（C错）的药物有甲氨蝶呤。干扰生物碱合成（D错）不能达到抗癌作用。